可提高体液渗透压的营养素是
A. 总脂肪
B. 饱和脂肪酸
C. 膳食纤维
D. 钠
E. 胆固醇

正确答案：D。钠

解析：本题考查可提高体液渗透压的营养素。钠盐（D对ABCE错）可提高体液渗透压，从而引起血压升高。